顺经汤的组成是
A. 当归、生地、白芍、丹皮、栀子、茜草、白茅根
B. 人参、麦冬、山药、半夏、大枣、甘草、丹参
C. 栀子、赤茯苓、当归、黄芩、白芍、生地、泽泻
D. 当归、熟地、沙参、白芍、茯苓、黑荆芥、丹皮
E. 生地、当归、川芎、蒲黄、牛膝、白芍、甘草梢

正确答案：D。当归、熟地、沙参、白芍、茯苓、黑荆芥、丹皮

解析：顺经汤《傅青主女科》组成是当归、熟地、白芍、丹皮、消参、茯苓、黑荆芥（D对），功效是滋阴润肺，清热凉血。主治治肺肾阴虚，虚火上炎所致的经期吐衄，手足心热，潮热咳嗽，咽干口渴，经来先期，量少，舌红，脉细数等症。方歌：傅氏女科顺经汤，当归熟地丹芍藏，沙参茯苓黑荆芥，经来吐衄效验彰。